狗脊的鉴别特征有
A. 药材表面被光亮的金黄色茸毛
B. 横切面近外皮处有一条明显凸起的棕黄色环纹
C. 根茎具双韧管状中柱
D. 木质部由导管组成
E. 皮层及髓部较宽，散有石细胞

正确答案：A、B、C。药材表面被光亮的金黄色茸毛；横切面近外皮处有一条明显凸起的棕黄色环纹；根茎具双韧管状中柱